可引起体液变色的药物是
A. 左氧氟沙星
B. 异烟肼
C. 吡嗪酰胺
D. 乙胺丁醇
E. 利福平

正确答案：E。利福平

解析：本题考查药物不良反应。可引起体液变色的药物是利福平（E对）。利福平服药后便尿，唾液、汗液、痰液、泪液等排泄物均可显橘红色。左氧氟沙星（A错）不良反应有消化系统反应，肝毒性，血液系统毒性和软骨系统毒性等。异烟肼（B错）主要不良反应为肝毒性和周围神经炎。吡嗪酰胺（C错）不良反应有关节痛、发热、乏力或软弱、眼或皮肤黄染、畏寒。乙胺丁醇（D错）不良反应为视神经炎、急性痛风、高尿酸血症、周围神经炎等。